药品质量标准“贮藏”项下的规定“凉暗处”系指
A. 不超过25℃
B. 不超过20℃
C. 避光并不超过25℃
D. 避光并不超过20℃
E. 2℃～10℃

正确答案：D。避光并不超过20℃

解析：本题考查中国药典的凡例。药品质量标准“贮藏”项下的规定“凉暗处”系指避光并不超过20℃（D对）。凉暗处是指药品贮藏处应避光且温度不超过20℃。阴凉处系指贮藏处的温度不超过20℃（B错）。冷处系指贮藏处温度为2℃～10℃（E错）。常温系指温度为10℃～30℃，因此25℃时的贮藏温度为常温（AC错）。